与居住、办公等场所比较起来，公共场所的特点不包括
A. 人群密集
B. 设备及物品易被污染
C. 涉及面广
D. 卫生设施齐全
E. 从业人员素质参差不齐

正确答案：D。卫生设施齐全

解析：本题考查与居住、办公等场所比较起来，公共场所的特点。与居住、办公等场所比较起来，公共场所有其特点，主要是：①人群密集（A对），流动性大。公共场所常在一定的空间和时间内接纳众多人群，不同性别、不同年龄、不同职业、不同身体状况（健康和非健康）的人员密切接触，给疾病传播提供了机会。此外，由于人群多为短期停留，流动性大，保洁意识差，也给卫生管理带来难度。②设备及物品易被污染（B对）。由于公共场所的设备和物品供公众长期反复使用，极易造成致病微生物污染，如不消毒或消毒不彻底，可通过交叉污染危害人群健康。③涉及面广（C对）。无论城乡，只要是有人群居住的地方，都会有大小不一、数量不等、建筑各异及功能不同的公共场所，因而涉及面广。④从业人员流动性大，素质参差不齐（E对）。随着社会经济的不断发展，公共场所不断增多，从业人员数量也随之增加，这些人员素质参差不齐，流动性大，给卫生制度的落实和卫生监督工作的开展带来一定的困难。卫生设施齐全（D错，为本题正确答案）不是公共场所的特点。